药物警戒和不良反应检测共同关注的是
A. 药品与食物不良相互作用
B. 药物误用
C. 药物滥用
D. 合格药品的不良反应
E. 药品用于无充分科学依据并未经核准的适应证

正确答案：D。合格药品的不良反应

解析：本题考查药物警戒。药物警戒不等同于药品不良反应监测：（1）监测对象不尽相同：药品不良反应监测的对象是质量合格的药品，而药物警戒涉及除质量合格药品之外的其他药品（D对），如低于法定标准的药品、药物与化合物的相互作用、药物及食物的相互作用（A错）等；（2）工作内容不尽相同：药物警戒工作包括药品不良反应监测工作以及其它工作，例如用药失误；缺乏疗效的报告；药品用于无充分科学依据并未经核准的适应证（E错）；急性与慢性中毒病例报告；药物相关死亡率的评价；药物滥用（C错）与误用（B错）。